右上腹绞痛伴黄疸的是
A. 胆总管结石
B. 壶腹癌
C. 胰头癌
D. 胆囊炎
E. 肝门部肿瘤

正确答案：A。胆总管结石

解析：胆总管结石（A对）可阻塞胆总管下端，使胆汁排出受阻，引起黄疸。当继发感染时，变现为典型的Charcot三联征：腹痛、寒战高热和黄疸。壶腹癌（B错）、胰头癌（C错）、肝门部肿瘤（E错）常表现为无痛性黄疸。胆囊炎（D错）虽然会有右上腹的疼痛，但不会阻塞胆汁排出通道引起黄疸。